代谢产物为活性代谢物，并已作为药品使用的是
A. 盐酸吗啡
B. 盐酸哌替啶
C. 枸橼酸芬太尼
D. 盐酸美沙酮
E. 盐酸溴己新

正确答案：E。盐酸溴己新

解析：本题考查祛痰药溴己新。溴己新（E对）在体内有活性的代谢物盐酸氨溴索，又名氨溴醇，已经开发成药品使用。盐酸吗啡（A错）大部分在体内与硫酸或葡萄糖醛酸结合后随尿排出。盐酸哌替啶（B错）体内代谢迅速，其主要代谢物有去甲哌替啶、哌替啶酸和去甲哌替啶酸等，其中仅去甲哌替啶有弱的镇痛作用。枸橼酸芬太尼（C错）的代谢产物无活性。盐酸美沙酮（D错）经代谢生成美沙醇，美沙醇镇痛活性弱于原药，再经代谢成去甲美沙醇和二去甲美沙醇，半衰期比美沙酮长，镇痛作用较长，但是不单独作为药品使用。